维持血液连续性流动的动力来自
A. 毛细血管
B. 大动脉
C. 中动脉
D. 小动脉．
E. 静脉

正确答案：B。大动脉

解析：大动脉（B对）是维持血液连续性流动的动力来源，当心室舒张时，管壁弹性回缩，推动血液继续向前流动。